下列哪项不是现况研究的目的
A. 掌握目标群体中某疾病的发病率及其分布状态
B. 提供疾病的病因线索
C. 确定高危人群
D. 对疾病进行监测
E. 评价预防接种效果

正确答案：A。掌握目标群体中某疾病的发病率及其分布状态